有关噻嗪类利尿药的叙述，错误的是
A. 具有降压作用
B. 可升高血脂
C. 使尿酸排出增加
D. 可升高血糖
E. 可促进远曲小管对钙离子的重吸收

正确答案：C。使尿酸排出增加

解析：本题考查噻嗪类利尿药的药理作用。有关噻嗪类利尿药的叙述，错误的是使尿酸排出增加（C错，为本题正确答案）。噻嗪类利尿药会干扰肾小管排泄尿酸，导致高尿酸血症，使尿酸排出减少，有诱发痛风的风险。噻嗪类利尿药用药早期通过利尿、减少血容量降压，长期用药则通过扩张外周血管降压，具有降压作用（A对）。长期使用噻嗪类利尿药可以使血清TC、LDL、VLDL轻度升高，可升高血脂（B对）。噻嗪类利尿药引起低血钾，低钾使胰岛素分泌减少并降低胰岛素的敏感性，可升高血糖（D对）。噻嗪类利尿药可促进远曲小管由甲状旁腺激素（PTH）调节钙离子重吸收过程，可促进远曲小管对钙离子的重吸收（E对）。